修复前口腔的“临床一般检查”不包括
A. 颌面部检查
B. 正畸治疗
C. 颞下颌关节的检查
D. 下颌运动检查
E. 缺牙部位的检查

正确答案：B。正畸治疗

解析：修复前的临床一般检查：颌面部检查、颞下颌关节区的检查、下颌运动检查和口腔内的检查。掌握“修复学临床检查”知识点。